免疫球蛋白V区的功能
A. 激活补体
B. 结合Fc受体
C. 穿越胎盘
D. 结合抗原表位
E. 穿越黏膜

正确答案：D。结合抗原表位

解析：①免疫球蛋白V区的功能：抗体和B细胞表面的Ig的V区的主要功能是特异性识别、结合抗原表位。②免疫球蛋白C区的功能：激活补体、结合Fc受体、穿越胎盘、穿越黏膜。掌握“免疫球蛋白基本概念及结构”知识点。